治疗重症肌无力的药物为
A. 解磷定
B. 安坦
C. 新斯的明
D. 阿托品
E. 左旋多巴

正确答案：C。新斯的明

解析：本题考查治疗重症肌无力的药物。新斯的明（C对）为易逆性胆碱脂酶抑制剂，可逆性抑制胆碱酯酶活性，加强和延长乙酰胆碱的作用，临床可用于重症肌无力；解磷定（A错）为胆碱酯酶复活剂，可解救有机磷中毒；安坦（苯海索）（B错）为中枢M受体阻断药，对帕金森的震颤和僵直有效；阿托品（D错）为M胆碱受体阻断药；左旋多巴（E错）为拟多巴胺类药，可以发挥抗帕金森病的作用。